女，70岁，因急腹症入院，急救过程中先后出现少尿、肺水肿、呼吸困难、嗜睡，意识障碍，消化道出血等症状，应诊断为
A. DIC
B. ARF
C. MODS
D. ARDS
E. Curling溃疡

正确答案：C。MODS

解析：患者为老年女性，急救急腹症过程中出现少尿、肺水肿、呼吸困难、嗜睡，意识障碍，消化道出血等症状，提示患者多器官功能出现损害，应诊断为MODS（C对），即多器官功能障碍。多器官功能衰竭（九版内科学P146）指机体在遭受急性严重感染、严重创伤、大面积烧伤等突然打击后，同时或先后出现2个或2个以上器官功能障碍。DIC（九版内科学P623）（A错），即弥漫性血管内凝血，表现为出血倾向、休克或微循环衰竭、溶血等。ARF（九版内科学P509）（B错），即急性肾衰竭，是指由多种病因引起的肾功能快速下降而出现的临床综合征，虽也可出现多器官功能受损，但以少尿、无尿、肾小球滤过率下降为突要表现。ARDS（九版内科学P130）（D错），即急性呼吸窘迫综合征，是指各种肺内和肺外致病因素所导致的急性弥漫性肺损伤和进而发展的急性呼吸衰竭，主要表现为呼吸窘迫、顽固性低氧血症和呼吸衰竭，肺部影像学表现为双肺渗出性病变。Curling溃疡（E错）是指中重度烧伤后继发的应激性溃疡。